下列不属于根尖周囊肿病理过程的是
A. 龋坏、牙髓炎症和坏死
B. 根尖周组织的炎症和免疫反应
C. Malassez上皮剩余增殖
D. 增殖上皮团块中央液化、囊性变
E. 牙体缺失

正确答案：E。牙体缺失

解析：本题考查根尖周囊肿。下列不属于根尖周囊肿病理过程的是牙体缺失（E错，为本题的正确答案）。根尖周囊肿是颌骨内最常见的牙源性囊肿，属于炎症性囊肿，一般经历牙齿龋坏、牙髓炎症和坏死（A对）、根尖周组织的炎症和免疫反应（B对）、Malassez上皮剩余增殖（C对）以及增殖上皮团块中央液化、囊性变（E对）等一系列病理过程，因此根尖周囊肿常发生于死髓牙的根尖部。